关于小网膜不正确的是
A. 位于肝门与胃、十二指肠上部之间
B. 由肝胃韧带和肝十二指肠韧带组成
C. 为四层腹膜结构
D. 其游离缘后方有Winslow孔
E. 肝十二指肠韧带内有肝门静脉、胆总管和肝固有动脉等结构

正确答案：C。为四层腹膜结构

解析：小网膜位于肝门、胃、十二指肠上部之间(A对)，由肝胃韧带和肝十二指肠韧带组成(B对)，为双层腹膜结构(C错，为本题正确答案)，其游离缘后方为网膜孔，又称Winslow孔(D对)，肝十二指肠韧带内有肝门静脉、胆总管及肝固有动脉(E对)。